肝素的抗凝作用主要依赖于
A. 抗凝血酶Ⅰ
B. 抗凝血酶Ⅱ
C. 抗凝血酶Ⅲ
D. 抗凝血酶Ⅳ
E. 抗凝血酶Ⅴ

正确答案：C。抗凝血酶Ⅲ

解析：肝素的抗凝作用主要依赖于抗凝血酶Ⅲ（AT-Ⅲ）。肝素可加速AT-Ⅲ-凝血酶复合物的形成达千倍以上，使酶失活。掌握“肝素、香豆素、阿司匹林和链激酶”知识点。